我国历史上第一部中药制剂规范是
A. 《备急千金要方》
B. 《外科正宗》
C. 《温病条辨》
D. 《太平惠民和剂局方》
E. 《本草纲目》

正确答案：D。《太平惠民和剂局方》